患者有上感史，急性心梗，除aVR外，多导联ST段弓背向下性抬高，心前区摩擦音，抓刮样粗糙音，应诊断为
A. 感染性心内膜炎
B. 急性心梗
C. 急性心包炎
D. 主动脉夹层
E. 心肌梗死后综合征

正确答案：C。急性心包炎

解析：该患者有上感史，急性心梗时（急性心包炎的常见病因），心电图呈ST段弓背向下性抬高（符合急性心包炎心电图表现），可闻及心前区摩擦音，抓刮样粗糙音（为急性心包炎的常见体征），综上所述，该患者应诊断为急性心包炎。感染性心内膜炎（A错）常表现为发热、心脏杂音（主动脉瓣关闭不全多见）、动脉栓塞，常见体征有Janeway损害、Osler结节、Roth斑。急性心梗（B错）分为ST抬高型心肌梗死和非ST段抬高型心肌梗死，前者出现宽而深的Q波，ST段呈弓背向上型抬高，后者无病理性Q波，普遍ST段压低≥0.1mV。主动脉夹层（D错），又称主动脉夹层动脉瘤，常急性起病，患者多表现为突发胸部剧烈疼痛，心电图无ST段改变。心肌梗死后综合征（E错），为急性心梗的的并发症，表现为心包炎、胸膜炎或肺炎，有发热、胸痛等症状。